头皮裂伤清创的一期缝合时间可放宽至
A. 24小时
B. 72小时
C. 4小时
D. 8小时
E. 48小时

正确答案：A。24小时

解析：头皮裂伤系头皮的开放伤，宜尽早行清创缝合术，如受伤时间达24小时，只要无明显感染征象，仍可彻底清创后行一期缝合。因此头皮裂伤清创的一期缝合时间可放宽至24小时（A对）。